可用于重度痤疮（尤其是结节囊肿型痤疮）的药品是
A. 过氧苯甲酰
B. 克林霉素
C. 阿达帕林
D. 异维A酸
E. 克罗米通

正确答案：D。异维A酸

解析：本题考查痤疮治疗药。可用于重度痤疮（尤其是结节囊肿型痤疮）的药品是异维A酸（D对）。异维A酸是维A酸的光学异构体，具有缩小皮脂腺，抑制皮脂腺活性，减少皮脂分泌，以及减轻上皮细胞分化和减少毛囊中痤疮丙酸杆菌的作用。对严重的结节囊肿型痤疮有高效作用。过氧苯甲酰（A错）用于治疗寻常痤疮。克林霉素（B错）主要治疗革兰氏阳性菌引起的各种感染性疾病,常见的有扁桃体炎、化脓性中耳炎、鼻窦炎等。阿达帕林（C错）用于以粉刺、丘疹和脓疤为主要表现的寻常型痤疮；面部、胸和背部的痤疮。克罗米通（E错）外用于疥疮、皮肤瘙痒。